年轻恒牙是指
A. 刚刚萌出的恒牙
B. 尚未萌出的恒牙
C. 年轻人的恒牙
D. 已经萌出，但牙根尚未发育完全的恒牙
E. 以上都不对

正确答案：D。已经萌出，但牙根尚未发育完全的恒牙

解析：本题考查年轻恒牙。恒牙一般在牙根形成2/3左右即牙根尚未发育完全（D对）时开始萌出，萌出后形态、结构上尚未完全形成和成熟，此种恒牙称年轻恒牙，年轻恒牙牙根会继续发育。尚未萌出的恒牙是恒牙胚（B错）。刚刚萌出的恒牙（A错）牙冠未完全萌出不能称年轻恒牙。年轻恒牙是指12～15岁儿童的牙齿，不指年轻人的恒牙（C错），年轻人的恒牙牙根已发育完成。牙冠在形态、结构上已形成和成熟。